具有抗心律失常、抗高血压及抗心绞痛作用的药物是
A. 可乐定
B. 普萘洛尔
C. 利多卡因
D. 硝酸甘油
E. 氢氯噻嗪

正确答案：B。普萘洛尔